以强制参保为原则，参保范围涵盖城镇所有用人单位和职工的保险为
A. 城镇职工基本医疗保险
B. 补充医疗保险
C. 城镇居民基本医疗保险
D. 社会医疗救助
E. 商业医疗保险

正确答案：A。城镇职工基本医疗保险

解析：参保范围涵盖城镇所有用人单位和职工的保险为城镇职工基本医疗保险，包括企业、机关、事业单位、社会团体、民办非企业单位的职工，属于社会医疗保险范畴，由国家通过立法强制实施（A对）。补充医疗保险是由单位、企业或特定人群，根据自己的经济承担能力，在基本医疗保险制度基础上自愿参加的各种辅助性的医疗保险，其主要解决参保人员基本医疗保险支付范围以外的医疗费用（B错）。城镇居民基本医疗保险的参保范围是不属于城镇职工基本医疗保险制度覆盖范围的中小学阶段的学生、少年儿童和其他非从业城镇居民（C错）。社会医疗救助的救助对象包括无固定收入、无生活依靠、无基本医疗保险的老龄者、失业者、残疾者以及生活在最低生活保障线以下的贫困者（D错）。商业医疗保险是由商业保险公司开办，以营利为目的，参保人员自愿参加的一种医疗保险制度（E错）。